伤寒属于
A. 变质性炎症
B. 浆液性炎症
C. 增生性炎症
D. 化脓性炎症
E. 出血性炎症

正确答案：C。增生性炎症

解析：伤寒病是由伤寒杆菌引起的炎症，即以巨噬细胞增生为特征的急性增生性炎症（C对），主要发生于肠道。变质性炎症（A错）指的是实质炎症细胞明显的变性和坏死，主要发生于心、肝、肾、骨骼肌等实质器官。浆液性炎症（P75）（B错）以浆液渗出为特征，主要发生于黏膜、浆膜、滑膜、皮肤等。化脓性炎症（P75）（D错）以中性粒细胞渗出，并伴有不同程度的组织坏死和脓液形成为特点，多由化脓菌感染所致，而感染伤寒的伤寒杆菌属于沙门氏菌，非化脓菌类。出血性炎症（P76）（E错）是指炎症病灶的血管损伤严重，常见于流行性出血热、钩端螺旋体病和鼠疫等。